慢性肾功能不全，血钾高于6.5mmol/L时，最佳的治疗措施是
A. 限制钾盐的摄入
B. 口服降钾树脂
C. 静推10%葡萄糖酸钙
D. 静注碳酸氢钠
E. 血液透析或腹膜透析

正确答案：E。血液透析或腹膜透析

解析：慢性肾功能不全，血钾高于6.5mmol/L（正常值3.5～5.5mmol/L）时，可以导致心脏骤停、甚至死亡，需要紧急处理，最佳的治疗措施是血液透析或腹膜透析（E对）。血液透析可以迅速清除体内的高钾，缓解症状。限制钾盐的摄入（A错）为高钾血症的预防措施。口服降钾树脂（B错）可以通过从肠道排钾降低血钾；静推10%葡萄糖酸钙（C错）可以拮抗高血钾对心肌的毒性作用；静注碳酸氢钠（D错）可以通过纠正酸中毒缓解高钾血症，但都起效较慢，不是最佳的治疗措施。